使可待因在体内被代谢为吗啡的肝药酶亚型是
A. CYP2D6
B. CYP3A4
C. CYP2C9
D. CYP2C19
E. CYP2B6

正确答案：B。CYP3A4

解析：本题考查肝药酶类型。肝药酶主要指细胞色素P450酶系，其具有很多同工酶，如CYP1A2、CYP3A4、CYP2C9、CYP2C19、CYP2D6、CYP2E1等。可待因是被CYP3A4（B对）代谢为吗啡的。